患者因后牙有洞要求治疗。查：右上6（牙合）面龋，去腐后达牙本质中层，该牙的最佳处理为
A. 聚羧酸锌水门汀垫底，银汞合金充填
B. 磷酸锌水门汀垫底，银汞合金充填
C. 玻璃离子水门汀充填
D. 玻璃离子水门汀垫底，银汞合金充填
E. 氧化锌丁香油糊剂垫底，银汞合金充填

正确答案：A。聚羧酸锌水门汀垫底，银汞合金充填

解析：题干诊断为深龋，应垫底后进行充填。磷酸锌粘固粉内的游离磷酸可对牙髓产生刺激；在调制最初的3分钟内pH为3.5，可刺激牙髓；1小时后pH上升到6.0；48小时后就接近中性。因此，深龋洞不应直接用磷酸锌粘固粉垫底。聚羧酸锌，对牙髓的刺激性较小，可作为良好的垫底材料。故答案为A。掌握“深龋的治疗”知识点。